男性，32岁，因口服敌敌畏重度中毒1小时入院，经阿托品氯磷定等各项治疗3天后神志清醒，中毒症状缓解，体征消失，再用阿托品口服维持6天后，查全血胆碱酯酶活力仍处于80%左右，究其原因，最可能是
A. 系高毒类毒物中毒
B. 胃肠、胆道内仍有残毒在吸收
C. 用解毒药剂量不足
D. 肝脏解毒功能差
E. 红细胞再生尚不足

正确答案：E。红细胞再生尚不足

解析：年轻男性患者，口服敌敌畏中毒后，经阿托品、氯磷定等治疗后，神志清醒，中毒症状缓解、体征消失，再用阿托品治疗6天后，全血胆碱酯酶仍未完全恢复。红细胞内真性ChE受抑制后一般不能恢复，只能待红细胞再生后全血胆碱酯酶测定值才能恢复正常水平，红细胞再生更新周期约为120天，本例患者治疗缓解6天后测定胆碱酯酶活性未完全恢复，究其原因为红细胞再生尚不足（E对）而非解毒药剂量不足（C错）。本例患者口服敌敌畏后发生有机磷中毒，敌敌畏虽属高毒类毒物，但经阿托品氯解定治疗后中毒症状已缓解、体征消失，说明中毒已基本控制，全血胆碱酯酶活性未完全恢复与其高度毒性无关（A错）。患者经6天后测定全血胆碱酯酶活性未完全恢复，此时胃肠道早已完全排空（B错）。OPI吸收后24小时内由肾排泄，48小时内完全排出体外，肝脏解毒功能差（D错）与全血胆碱酯酶未完全恢复无关。